茎方柱形，叶对生，气芳香药材有
A. 荆芥
B. 鱼腥草
C. 薄荷
D. 广藿香
E. 紫花地丁

正确答案：A、C、D。荆芥；薄荷；广藿香

解析：本题考查的是具有相同性状特征的药材。茎方柱形，叶对生，气芳香药材有荆芥（A对）、薄荷（C对）与广藿香（D对）。广藿香：【性状鉴别】药材茎略呈方柱形，多分枝，枝条稍曲折；表面被柔毛；质脆，易折断，断面中部有髓；老茎类圆柱形，被灰褐色栓皮。叶对生，皱缩成团，展平后叶片呈卵形或椭圆形；两面均被灰白色绒毛；先端短尖或钝圆，基部楔形或钝圆，边缘具大小不规则的钝齿；叶柄细，被柔毛。气香特异，味微苦。荆芥：【性状鉴别】药材茎方柱形，上部有分枝；表面淡黄绿色或淡紫红色，被短柔毛；体轻，质脆，断面类白色。叶对生，多已脱落，叶片3～5羽状分裂，裂片细长。穗状轮伞花序顶生。花冠多已脱落，宿萼钟形，顶端5齿裂，淡棕色或黄绿色，被短柔毛；小坚果4，矩圆状三棱形，棕黑色。气芳香，味微涩而辛凉。薄荷：【性状鉴别】药材茎呈方柱形，有对生分枝；表面紫棕色或淡绿色，棱角处具茸毛；质脆，断面白色，髓部中空。叶对生，有短柄；叶片皱缩卷曲，完整者展平后呈宽披针形、长椭圆形或卵形；上表面深绿色，下表面灰绿色，稀被茸毛，有凹点状腺鳞。轮伞花序腋生，花萼钟状，先端5齿裂，花冠淡紫色。揉搓后有特殊清凉香气，味辛凉。鱼腥草（B错）：【性状鉴别】药材鲜鱼腥草茎呈圆柱形；上部绿色或紫红色，下部白色，节明显，下部节上生有须根，无毛或被疏毛。叶互生，叶片心形；先端渐尖，上表面绿色，密生腺点，下表面常紫红色；叶柄细长，基部与托叶合生成鞘状。穗状花序顶生。具鱼腥气，味涩。紫花地丁（E错）：【性状鉴别】药材多皱缩成团。主根长圆锥形；淡黄棕色，有细纵皱纹。叶基生，灰绿色，展平后叶片呈披针形或卵状披针形；先端钝，基部截形或稍心形，边缘具钝锯齿，两面有毛；叶柄细，上部具明显狭翅。花茎纤细；花瓣5，紫堇色或淡棕色；花距细管状。蒴果椭圆形或3裂，种子多数，淡棕色。气微，味微苦而稍黏。